可釆用维生素治疗的贫血
A. 缺铁性贫血
B. 再生障碍性贫血
C. 溶血性贫血
D. 巨幼细胞性贫血
E. 甲状腺功能减退所致贫血

正确答案：D。巨幼细胞性贫血

解析：巨幼细胞性贫血（D对）是由于叶酸或维生素B₁₂缺乏或某些影响核苷酸代谢的药物导致细胞核脱氧核糖核酸（DNA）合成障碍所致的贫血，其主要治疗手段是治疗原发疾病，补充缺乏的营养物质如叶酸或维生素B₁₂；缺铁性贫血（P541）（A错）是由于血红蛋白合成原料铁缺乏引起的贫血，应给予补充铁剂治疗；再生障碍性贫血（P547）（B错）是多种机制和病因引起的骨髓造血功能衰竭，应给予免疫抑制、促造血或造血干细胞移植治疗；溶血性贫血（P551）（C错）是由于红细胞自身或外部异常导致的红细胞破坏过多引起的贫血，应给予糖皮质激素或切脾治疗；甲状腺功能减退所致贫血（E错）是由于甲状腺激素减少导致铁和叶酸吸收障碍，血红蛋白合成减少引起的贫血，应给予甲状腺激素替代治疗。